龋损在釉质或根面牙骨质层内，探查时可以感觉表面粗糙，弥散范围大。一般无明显自觉症状的患牙，可以诊断为
A. 浅龋
B. 中龋
C. 深龋
D. 静止龋
E. 猛性龋

正确答案：A。浅龋

解析：浅龋：龋损在釉质或根面牙骨质层内，探查时可以感觉表面粗糙，患者一般无明显自觉症状。掌握“龋病的诊断及鉴别诊断”知识点。